手足口病潜伏期为
A. 1～10天
B. 2～10天
C. 2～11天
D. 3～11天
E. 5～15天

正确答案：B。2～10天